对一年前做过口腔检查的200名患者进行口腔健康检查时，发现有40个新龋需要治疗，描述这种情况的指标
A. 龋均
B. 患龋率
C. 龋病发病率
D. 龋面充填构成比
E. 龋面均

正确答案：C。龋病发病率

解析：本题考查龋病常用指数-龋病发病率的定义。对一年前做过口腔检查的200名患者进行口腔健康检查时，发现有40个新龋需要治疗，描述这种情况的指标是龋病发病率（C对）。龋病发病率通常是指至少在一年时间内，某人群新发生龋病的频率。龋均（A错）是指受检人群中每人口腔中平均龋、失补牙数。患龋率（B错）指在调查期间某一人群中患龋病的频率，主要用于龋病流行情况的研究。龋面充填构成比（D错）指一组人群的龋、失、补牙面之和中已充填的龋面所占的比重，常用百分数表示。龋面均（E错）指受检人群中每人口腔中平均龋、失、补牙面数。